为了评估高血压在Ⅱ型糖尿病合并肾病中的作用。回顾性分析了按年龄、性别、种族、居住地匹配的两组Ⅱ型糖尿病患者，其中1组为非蛋白尿组（尿蛋白300mg/24h，n=106），另1组为蛋白尿组（尿蛋白≥500mg/24h，n=106）。回顾性分析了出现蛋白尿之前高血压的患病情况，分析显示：高血压与蛋白尿的比值比（OR）及其95％的可信区间为2.30（1.17～3.43）。正确的结论是
A. 高血压可增加蛋白尿发生的危险，高血压是蛋白尿发生的危险因素
B. 高血压可减少蛋白尿发生的危险，高血压是蛋白尿发生的保护因素
C. 高血压与蛋白尿发生无统计学联系
D. 蛋白尿组高血压的发病率高于非蛋白尿组
E. 非蛋白尿组高血压的发病率高于蛋白尿组

正确答案：A。高血压可增加蛋白尿发生的危险，高血压是蛋白尿发生的危险因素